质硬坚实、断面角质样的药材有
A. 郁金
B. 延胡索
C. 葛根
D. 黄芪
E. 天麻

正确答案：A、B、E。郁金；延胡索；天麻

解析：本题考查的是郁金和天麻药材的鉴别。质硬坚实、断面角质样的药材有郁金（A对）、延胡索（B对）与天麻（E对）。郁金：【性状鉴别】药材温郁金呈长圆形或卵圆形，稍扁，有的微弯曲，两端渐尖。表面灰褐色或灰棕色，具不规则纵皱纹，纵纹隆起处色较浅。质坚实，横断面灰棕色，角质样；内皮层环明显。气微香，味微苦。延胡索：【性状鉴别】药材呈不规则扁球形。表面黄色或黄褐色，有不规则网状皱纹，顶端有略凹陷的茎痕，底部常有疙瘩状突起。质硬而脆，断面黄色，角质样，有蜡样光泽。气微，味苦。天麻：【性状鉴别】药材呈椭圆形或长条形，略扁，皱缩而稍弯曲。表面黄白色至淡黄棕色，有纵皱纹及由点状突起（潜伏芽）排列而成的横环纹多轮，有时可见鳞叶或棕褐色菌索。顶端有红棕色至深棕色鹦嘴状的芽苞或残留茎基；底部有圆脐形疤痕。质坚硬，不易折断，断面较平坦，黄白色至淡棕色，角质样。气微，味甘。葛根（C错）：【性状鉴别】药材呈纵切的长方形厚片或小方块。外皮淡棕色至棕色，有纵皱纹，粗糙。切面黄白色至淡黄棕色，有的纹理不明显。质韧，纤维性强。气微，味微甜。黄芪（D错）：【性状鉴别】药材呈圆柱形，有的有分枝，上端较粗。表面淡棕黄色或淡棕褐色，有不整齐的纵皱纹或纵沟。质硬而韧，不易折断，断面纤维性强，并显粉性，皮部黄白色，木部淡黄色，具放射状纹理及裂隙。老根中心偶呈枯朽状，黑褐色或呈空洞。气微，味微甜，嚼之微有豆腥味。